慢性肾功能不全伴高血钾应选用药物
A. 葡萄糖酸钙
B. 碳酸氢钠
C. 呋塞米
D. 阳离子交换
E. 氨基酸

正确答案：A。葡萄糖酸钙

解析：对于肾功能不全的高钾血症，不可输液过多，可用10%葡萄糖酸钙（A对）100ml+11.2%乳酸钠50ml+25%葡萄糖溶液400ml，加入胰岛素20U，做24小时缓慢静脉滴入，不仅可以促使K⁺转入细胞内，而且还能缓解钾对心肌的毒性作用。静脉输注5%碳酸氢钠溶液（B错）可使血容量增加，不仅可使血清K⁺得到稀释，降低血钾浓度，又能使K⁺移入细胞内或由尿排出，同时还有助于酸中毒的治疗，但慢性肾功能不全患者不可输入过多液体，故不应选用。口服阳离子交换树脂（D错）虽可从消化道带走钾离子，且不加重肾脏负担，但易导致便秘和粪块堵塞，而不作为首选。呋塞米（C错）为排钾利尿剂，虽可降低血钾，也可以用于慢性肾功能不全，但其主要作用为利尿，主要用于水肿和高血压，若用呋塞米来治疗高血钾，则副作用较多，不可取。氨基酸（E错）对治疗高血钾症无意义。